宜用米炒的中药是
A. 柴胡
B. 鳖甲
C. 延胡索
D. 斑蝥
E. 乳香

正确答案：D。斑蝥

解析：本题考查的是斑蝥的炮制方法。宜用米炒的中药是斑蝥（D对）。斑蝥：【炮制方法】处方用名有斑蝥、炒斑蝥、米炒斑蝥。柴胡（A错）：【炮制方法】处方用名有柴胡、炙柴胡、醋柴胡、鳖血柴胡。鳖甲（B错）：【炮制方法】处方用名有鳖甲、炙鳖甲、制鳖甲、酥鳖甲、烫鳖甲。延胡索（C错）：【炮制方法】处方用名有延胡索、醋延胡索、酒延胡索。乳香（E错）：【炮制方法】处方用名有乳香、炒乳香、炙乳香、醋乳香。